酸碱滴定法使用的滴定液是
A. 氢氧化钠滴定液
B. 硫酸铈滴定液
C. 高氯酸滴定液
D. 碘滴定液
E. 乙二胺四醋酸二钠滴定液

正确答案：A。氢氧化钠滴定液

解析：本题考查酸碱滴定法。酸碱滴定法使用的滴定液是氢氧化钠滴定液（A对）。酸碱滴定法中常使用的酸滴定液是硫酸滴定液和盐酸滴定液，碱滴定液是氢氧化钠滴定液。硫酸铈滴定液（B错）是氧化还原滴定法中铈量法的滴定液。高氯酸滴定液（C错）是非水溶液滴定法中非水碱量法的滴定液。碘滴定液（D错）是氧化还原滴定法中碘量法的滴定液。乙二胺四醋酸二钠滴定液（E错）是配位滴定法的滴定液。